营养性巨幼细胞贫血
A. 大细胞性贫血
B. 正细胞性贫血
C. 单纯小细胞性贫血
D. 小细胞低色素性贫血
E. 造血不良性贫血

正确答案：A。大细胞性贫血

解析：本题考查营养性巨幼细胞贫血的相关内容。营养性巨幼细胞贫血是一种大细胞性贫血（A对BCDE错）。由于脱氧核糖核酸合成障碍所引起的一种贫血，主要系体内缺乏维生素B12和/或叶酸所致，亦可因遗传性或药物等获得性DNA合成障碍引起。